分析用药剂量合理性的方法是
A. 成本效益分析
B. 成本效用分析
C. 用药频度分析
D. 药物利用指数分析
E. 流行病学分析

正确答案：D。药物利用指数分析

解析：本题考查药物利用指数分析。药物利用指数分析（D对）：用来测量医师使用某药的日处方剂量，对医师用药剂量的合理性进行分析。